女性，13岁。昨日进食海鲜，今晨开始畏寒、发热、腹痛，以左下腹痛为重，腹泻伴明显里急后重，日大便8次，初为稀便，继之为粘液脓血便。此病例的诊断为
A. 急性轻型细菌性痢疾
B. 急性普通型细菌性痢疾
C. 中毒型细菌性痢疾
D. 霍乱
E. 急性肠炎

正确答案：B。急性普通型细菌性痢疾

解析：13岁女性患儿，昨日进食海鲜（致病菌经粪口传播可能性大），今晨开始畏寒发热腹痛，以左下腹痛为重，腹泻伴明显里急后重，日大便8次，初为稀便，继之为粘液脓血便（急性菌痢普通型典型临床表现），此病例的诊断为急性普通型细菌性痢疾（B对）。急性轻型细菌性痢疾（A错）全身毒血症状轻微，可无发热或仅低热，表现为急性腹泻，稀便有粘液但无脓血。中毒性菌痢（C错）起病急骤，突起畏寒高热，病势凶险，全身中毒症状严重，可有嗜睡、昏迷及抽搐，分为休克型、脑型、混合型。霍乱（D错），腹泻为发病第一个症状，无发热无里急后重，不伴腹痛，无粪臭，可排泄“米泔水”样液体，可出现脱水、电解质紊乱、循环衰竭等严重症状。急性胃肠炎（E错）起病较急，有恶心、呕吐、腹痛、腹泻等症状，腹痛以上、中腹持续或阵发性绞痛多见，腹泻轻重不一，多为黄色稀便、水样便或黏液便。